药物出现副作用的主要原因是
A. 药物剂量过大
B. 药物的选择性低
C. 病人对药物过敏
D. 药物代谢的慢
E. 药物排泄的慢

正确答案：B。药物的选择性低

解析：副作用：通常也称副作用，由于药物的选择性低，药理效应涉及多个器官，当某一效应用做治疗目的时，其他效应就成为副作用。掌握“药物不良反应”知识点。